牙周病基础治疗的重点是
A. 药物治疗
B. 咬合调整
C. 菌斑控制
D. 松牙固定
E. 治疗食物嵌塞

正确答案：C。菌斑控制

解析：本题考查牙周病基础治疗的重点。牙周病基础治疗的重点是菌斑控制（C对），因为菌斑是牙周病的始动因子，即使除去之后还会不断地在牙面重新形成，因此必须坚持每天彻底地进行菌斑控制，才能预防牙周病的发生和复发。药物治疗（A错）起到辅助治疗的目的，进行抗菌药物治疗前或治疗的同时，必须尽量彻底地清除菌斑牙石，才能控制牙周炎症。咬合调整（B错）是牙周病基础治疗重要的手段，主要用于存在创伤性牙合的牙周病，不是牙周病基础治疗的重点。松牙固定（D错）是牙周病基础治疗的重要组成部分，主要用于妨碍咀嚼或有不适的松动牙，也不是牙周病基础治疗的重点。通过调（牙合）法治疗食物嵌塞（E错）只能改善牙齿邻面牙周状况，若菌斑持续存在牙周炎症不会消退，所以牙周病基础治疗的重点在于菌斑控制。